在治疗失血性休克中补充血容量时，最佳的晶体液为
A. 5%葡萄糖溶液
B. 5%葡萄糖盐水
C. 平衡盐溶液
D. 10%葡萄糖溶液
E. 4%苏打溶液

正确答案：C。平衡盐溶液

解析：失血性休克为低血容量性休克的一种，治疗的过程中应该首先应快速滴注等渗盐水或平衡盐溶液来补充血容量。掌握“休克”知识点。